男，48岁。反酸、烧心5个月。胃镜检查：反流性食管炎伴溃疡形成。最佳的治疗药物是
A. 硫糖铝
B. 枸橼酸铋钾
C. 奥美拉唑
D. 铝碳酸镁
E. 雷尼替丁

正确答案：C。奥美拉唑

解析：患者中年男性，以反酸、烧心为主要临床表现，根据胃镜检查诊断为反流性食管炎伴溃疡形成。食管炎伴溃疡形成的患者宜以PPI治疗，以求迅速控制症状、治愈食管炎，奥美拉唑属于PPI（C对）。雷尼替丁（E错）属于H2受体阻滞剂。硫糖铝（A错）、枸橼酸铋钾（B错）、铝碳酸镁（D错）属于胃黏膜保护剂。